女，50岁。糖尿病肾病伴高血压。BP170/100mmHg，心率54次/分，血肌酐158μmol/L。最适宜的治疗药物组合是
A. 氢氯噻嗪、吲达帕胺
B. 氨氯地平、缬沙坦
C. 美托洛尔、维拉帕米
D. 普奈洛尔、卡托普利
E. 螺内酯、福辛普利

正确答案：B。氨氯地平、缬沙坦

解析：患者中老年女性，糖尿病肾病伴高血压，BP170/100mmHg（正常值90～139/60～89mmHg，提示中度高血压），心率偏慢（正常值60～100次/分），血肌酐稍偏高（正常值44～133μmol/L），最适宜的治疗药物组合是氨氯地平、缬沙坦（B对）。缬沙坦为血管紧张素Ⅱ受体拮抗剂（ARB），和血管紧张素转换酶抑制剂（ACEI）一样，具有改善胰岛素抵抗和减少尿蛋白作用，特别适合于糖尿病肾病伴高血压患者。氨氯地平为二氢吡啶类钙通道拮抗剂，可使交感活性反射性增强，引起心率增快，对老年患者也有较好降压效果。本患者心率偏慢（54次/分），故可使用氨氯地平治疗。综上所诉，此患者最适宜的治疗药物组合是氨氯地平、缬沙坦。吲达帕胺（九版药理学P214）为类似噻嗪类的利尿剂，其利尿作用与噻嗪类相似，故氢氯噻嗪、吲达帕胺（A错）合用会进一步升高血糖、血脂等，不适合糖尿病肾病伴高血压患者。美托洛尔为选择性β₁受体阻滞剂，普奈洛尔为非选择性β受体阻滞剂，两者对心肌都有负性频率作用，即减慢患者心率，使用这两种药可能导致严重心动过缓，而产生一系列临床症状，因此美托洛尔、维拉帕米（C错）和普奈洛尔、卡托普利（D错）两组组合药物不适合本例患者。螺内酯为保钾利尿剂，可引起高血钾，不宜与ACEI（包括福辛普利）、ARB合用，肾功能不全者慎用（P253），故螺内酯、福辛普利（E错）也不是最适宜的治疗药物组合。